诊断卵巢上皮性癌价值最大的肿瘤标志物是
A. hCG
B. CA125
C. AFP
D. CA19-9
E. PSA

正确答案：B。CA125

解析：诊断卵巢上皮性癌价值最大的肿瘤标志物是CA125（B对）。hCG（A错）的检查对早期妊娠诊断有重要意义，对与妊娠相关疾病、滋养细胞肿瘤等疾病的诊断、鉴别和病程观察等有一定价值，还对非妊娠性卵巢绒癌有特异性。AFP（甲胎蛋白）（P329）（C错）对卵黄囊瘤的诊断及病情监测有重要价值。CA19-9（D错）是胰腺癌和结、直肠癌的肿瘤标志物。PSA（前列腺特异抗原）（E错）是前列腺癌的特异性标志物。